男性，62岁。慢性咳嗽10年，近半月来出现阵发性干咳，持续痰中带血。X线胸片显示左肺下叶不张。为明确诊断最有意义的检查方法为
A. 纤维支气管镜检查
B. 痰细菌培养
C. 结核菌素试验
D. 肺功能测定
E. 血清癌胚抗原测定

正确答案：A。纤维支气管镜检查

解析：患者为中老年男性（为肺癌的好发年龄），有慢性咳嗽病史，近半月来出现阵发性干咳，持续痰中带血，为支气管肺癌典型临床表现，X线胸片显示左肺下叶不张，根据其临床表现和辅助检查，疑诊中央型肺癌。纤维支气管镜检查（A对）对中央型肺癌诊断、确定病变范围、明确手术指征与方式有帮助，纤支镜可见的支气管内病变，刷检加活检的阳性率可达90%左右。痰细菌培养（B错）适用于确诊肺部的感染，患者无发热的表现，可排除肺部感染。结核菌素试验（C错）适用于结核病的诊断，患者无低热、盗汗等结核中毒症状，结合X线胸片可排除结核病。肺功能测定（D错）适用于慢性阻塞性肺疾病及肺纤维化等通气功能障碍疾病。血清癌胚抗原测定（E错）对肺癌的诊断有一定参考价值，并不是明确诊断最有意义的检查方法。